儿茶酚胺类递质包括
A. 肾上腺素和去甲肾上腺素
B. 肾上腺素、去甲肾上腺索和与5-羟色胺
C. 肾上腺素、去甲肾上腺素和多巴胺
D. 肾上腺素和多巴胺
E. 多巴胺和5-羟色胺

正确答案：C。肾上腺素、去甲肾上腺素和多巴胺